可用于治疗支气管哮喘
A. 麻黄碱
B. 伪麻黄碱
C. 二者均是
D. 二者均不是

正确答案：C。二者均是